具有喜燥恶湿特性的脏腑是
A. 肝
B. 肺
C. 脾
D. 胃
E. 大肠

正确答案：C。脾

解析：该题考查脏腑的生理特性。肝的生理特性：肝为刚脏、肝气升发（A错）。肺的生理特性：肺为华盖，肺为娇脏，肺气宣降（B错）。脾的生理特性：脾气主升，喜燥恶湿（C对）。胃的生理特性：胃气通降，喜润恶燥（D错）。大肠的生理特性：以通降为顺，传导有度（E错）。